患儿，5周岁。两周前曾患上感冒，目前不规则发热，易倦，脸色略苍白，查体发现心率增快，心尖部第一心音减弱，并可闻及早搏，心电图检查：P-R间期延长，ST段下移，实验室检查：C-反应蛋白增高。该患儿的临床诊断最可能是
A. 病毒性心肌炎
B. 风湿性心肌炎
C. 风湿性心包炎
D. 结核性心包炎
E. 类风湿性心包炎

正确答案：B。风湿性心肌炎

解析：该患儿的临床诊断最可能是风湿性心肌炎。根据题中的典型临床表现：不规则发热，易倦，脸色略苍白，查体发现心率增快，心尖部第一心音减弱，并可闻及早搏，结合心电图检查：P-R间期延长，ST段下移，实验室检查：C-反应蛋白增高。我们不难判断出该患儿是风湿性心肌炎（B对）。病毒性心肌炎（A错）（P279）病毒感染时，CRP在绝大多数病毒感染中的血清浓度变化不大或基本保持不变；另外病毒性心肌炎可见各种严重的心率失常，如各种期前收缩、房颤、室颤、Ⅱ度或Ⅲ度方式传导阻滞等。同时心电图有明显的T波降低，但心电图缺乏特异性，需要动态观测。风湿性心包炎（P155）（C错）心电图示低电压，早期ST段抬高，随后ST段回到等电线，并出现T波改变；超声可确诊少量心包积液。结核性心包炎（D错）是缩窄性心包炎的主要成因，心电图示QRS低电压、T波低平或倒置。类风湿性心包炎（E错）一般出现在RF阳性，有类风湿结节的患者，但多数患者无相关临床表现。